心理治疗中，对治疗师的伦理要求不正确的是
A. 掌握和运用心理治疗的知识、技巧去开导患者
B. 有同情、帮助患者的诚意
C. 保守患者的隐私、秘密
D. 满足患者的饮食习惯和营养需求
E. 以健康的心理状态去影响和帮助患者

正确答案：D。满足患者的饮食习惯和营养需求

解析：在心理治疗过程中，对治疗师的伦理要求是：1)要掌握和运用心理治疗的知识、技巧去开导患者；2)要有同情、帮助患者的诚意；3)要以健康、稳定的心理状态去影响和帮助患者；4)要保守患者的秘密、隐私。D项为饮食营养治疗中对营养师的伦理要求。掌握“临床治疗和临床急救的伦理”知识点。